有关急性一氧化碳中毒描述正确的有
A. 一般导致低张性缺氧
B. 患者中毒后有短暂昏迷，入院前已经清醒，入院后1天观察无明显不适，则可院外观察，不需特殊治疗
C. 不能吸入高浓度氧，以免导致氧中毒
D. 入院查碳化血红蛋白正常则可排除一氧化碳中毒
E. 早期行高压氧治疗是有效的

正确答案：E。早期行高压氧治疗是有效的

解析：急性一氧化碳中毒应尽早给予吸氧治疗，高浓度氧气有助于一氧化碳的排出（E对C错）。急性一氧化碳中毒导致的是贫血性缺氧（A错）。急性一氧化碳中毒患者从昏迷中苏醒后，应尽可能留院休息观察，以防神经系统和心脏后发症的发生，如发生神经精神后发症，给予相应治疗（八版内科学P908）（B错）。入院查碳化血红蛋白正常不排除一氧化碳中毒（D错），采取血标本要求在脱离中毒现场8小时以内尽早抽取静脉血（八版内科学P908）。